关于乳牙的描述,正确的是
A. 有24个
B. 2~3岁出齐
C. 5d表示上颌左侧第2乳磨牙
D. 11d表示下颌左侧中切牙
E. 以上全错

正确答案：B。2~3岁出齐

解析：乳牙共20个(A错)，大约在2～3岁出齐(B对)，5d表示上颌右侧第二乳磨牙(C错)，11d表示下颌左侧乳中切牙(D错)。